为预防营养性维生素D缺乏性佝偻病，小儿每日口服维生素D的剂量是
A. 1600～2000IU
B. 400～800IU
C. 1300～1500IU
D. 200～300IU
E. 900～1200IU

正确答案：B。400～800IU

解析：早产儿、低出生体重儿、双胎儿生后1周开始补充维生素D 800IU/d，3个月后改预防量；足月儿生后2周开始补充维生素D400IU/d，均补充至2岁。因此为预防营养性维生素D缺乏佝偻病，小儿每日口服维生素D的量是400～800IU（B对）。